女，57岁，寒战发热（最高体温达38.7℃），全身不适，恶心呕吐2天。体检：血压145/85mmHg，肾区有叩击痛。尿常规：蛋白（++），白细胞满视野，红细胞8～10/HP。中段尿细菌培养为阳性。查双肾B超肾功能均无异常。5年来有多次类似发作，近2年来夜尿明显增多。此患者最可能的诊断为慢性肾盂肾炎
A. 低热型
B. 复发型
C. 血尿型
D. 隐匿型
E. 高血压型

正确答案：B。复发型

解析：中老年女性，寒战高热，全身不适，恶心呕吐2天。体检：高血压，肾区有叩击痛（提示肾盂肾炎可能）。尿蛋白阳性，镜下白细胞满视野（提示有尿路感染），红细胞8～10/HP （正常值0～3个/HP）。中段尿细菌培养为阳性。查双肾B超肾功能均无异常。5年来有多次类似发作，近2年来夜尿明显增多。可诊断为慢性肾盂肾炎急性发作。为慢性肾盂肾炎分型中的反复发作型（B对）：此型为典型慢性肾盂肾炎，病人经常反复发生尿路刺激症状，伴有菌尿，常有低热或中等热度，肾区钝痛，诊断多无困难。长期低热型（A错）：患者无尿路刺激症状，仅有低热、头昏、疲乏无力、体重减轻及食欲减退等一般症状，易误诊为神经性低热、结核病或其它慢性感染性疾病。隐匿型（D错）又称无症状性菌尿：患者既无全身症状，又无尿路刺激症状，而尿中常有多量的细菌、少量白细胞，偶见管型。此型多见于妊娠妇女及女孩。高血压型（E错）：病人既往可有尿路感染病史，但主要临床表现是以头昏、头痛及疲乏为特征的高血压症状，或偶尔检查发现有高血压，而无尿路刺激症状，可有间歇性菌尿或无菌尿。慢性肾盂肾炎无血尿型（C错）。